对干啰音的描述，不正确的是
A. 音调较高
B. 持续时间较长
C. 吸气时也可听到
D. 呼气时更为明显
E. 部位较固定

正确答案：E。部位较固定

解析：干啰音是由于气管、支气管或细支气管狭窄或部分阻塞，空气吸入或呼出时形成湍流所产生的声音。干啰音一种持续时间较长带乐性的呼吸附加音，音调较高（A对），基音频率约300～500Hz。持续时间较长（B对），吸气及呼气时均可听及（C对），但是以呼气时为明显（D对），强度和性质易改变，部位易变换（E错，为本题正确答案）。